含有亚硝基脲结构，易能过血脑屏障进入脑脊液的药物是
A. 氟达拉滨
B. 卡莫司汀
C. 顺铂
D. 环磷酰胺
E. 培美曲塞

正确答案：B。卡莫司汀

解析：本题考查卡莫司汀。卡莫司汀（B对）含亚硝基脲结构，脂溶性大，能透过血脑屏障进入脑组织，可用于原发性脑瘤、脑转移瘤、脑膜白血病等。氟达拉滨（A错）是阿糖腺苷的衍生物。顺铂（C错）属于金属配合物抗肿瘤药物。环磷酰胺（D错）属于氮芥类烷化剂。培美曲塞（E错）为具有多靶点的抗肿瘤药物。